乙脑的主要治疗是
A. 扩容为主
B. 补液为主
C. 对症为主
D. 抗菌为主
E. 抗病毒为主

正确答案：C。对症为主

解析：目前尚无特效的抗乙脑病毒药物，早期可试用利巴韦林、干扰素等。需采取综合治疗措施，积极对症、支持治疗并做好护理工作（C对）。高热、抽搐及呼吸衰竭是危及患者生命的三大主要症状。且可互为因果，形成恶性循环，因此必须及时给予相应处理。